用作牙周冲洗液的过氧化氢溶液的浓度为
A. 0.005
B. 0.01
C. 0.015
D. 0.02
E. 0.03

正确答案：E。0.03

解析：本题考查慢性牙周炎的治疗原则、程序及方法。过氧化氢溶液：1%用于含漱，3%（E对）用于冲洗，30%用于牙齿漂白。